淋巴管道包括有
A. 毛细淋巴管
B. 淋巴管
C. 淋巴干
D. 淋巴导管
E. 以上都是

正确答案：E。以上都是

解析：淋巴管道包括毛细淋巴管（A对）、淋巴管（B对）、淋巴干（C对）和淋巴导管（D对，E为本题正确答案），毛细淋巴管合成淋巴管，淋巴管合成淋巴干、淋巴干合成淋巴导管。